用于散瞳的眼用药物是
A. 溴莫尼定
B. 噻吗洛尔
C. 毛果芸香碱
D. 复方托吡卡胺
E. 拉坦前列素

正确答案：D。复方托吡卡胺

解析：本题考查散瞳药。用于散瞳的眼用药物是复方托吡卡胺（D对）。溴莫尼定（A错）为α₂受体激动剂类降眼压药。噻吗洛尔（B错）为β受体阻断剂类降眼压药。毛果芸香碱（C错）为拟胆碱类降眼压药。拉坦前列素（E错）为前列腺素衍生物类降眼压药。